Bishop宫颈成熟度评分，应得2分的项目是
A. 宫口位置在前
B. 宫口开大5cm
C. 宫颈管消退80％
D. 宫颈中等度硬
E. 胎头位置+1

正确答案：A。宫口位置在前

解析：Bishop宫颈成熟度评分，应得2分的项目是宫口位置在前（A对），宫口开大3～4cm（B错），宫颈管消退60%～70%（C错），宫颈硬度程度为软（D错），先露位置﹣1～0（E错）。